硝酸甘油对下列哪类血管扩张作用很弱
A. 小动脉
B. 小静脉
C. 冠状动脉的输送血管
D. 冠状动脉的侧枝血管
E. 冠状动脉的小阻力血管

正确答案：E。冠状动脉的小阻力血管